仅在脊髓第一胸节到第三腰节的横切面上可见到的灰质部分
A. 前角
B. 后角
C. 侧角
D. 脊髓圆锥
E. 无

正确答案：C。侧角

解析：每侧的灰质，前部扩大为前角（A错），后部狭细为后角（B错） ，在胸髓和上腰髓 (T1～L3), 中间带外侧部向外伸出侧角，侧角（C对）在脊髓第一胸节到第三腰节的横切面上可见到的灰质部分，脊髓圆锥（D错）尖端约平对第 1 腰椎下缘（新生儿可达第 3 腰椎下缘）。